以早发现早休息早治疗和少搬动“三早一少”为治疗关键的疾病是
A. 流行性脑脊髓膜炎
B. 流行性乙型脑炎
C. 流行性出血热
D. 狂犬病
E. 伤寒

正确答案：C。流行性出血热

解析：流行性出血热的治疗原则是“三早一近”，即早发现、早休息、早治疗和就近治疗（C对）。